不能经垂直传播的病毒是
A. 风疹病毒
B. 巨细胞病毒
C. 乙型肝炎病毒
D. AIDS病毒
E. 脊髓灰质炎病毒

正确答案：E。脊髓灰质炎病毒

解析：垂直传播：指通过胎盘或产道，病毒直接由亲代传播给子代的方式。常见导致垂直传播的病毒有风疹病毒、乙型肝炎病毒（HBV）、AIDS病毒（HIV）、丙型肝炎病毒（HCV）、巨细胞病毒（CMV）等十余种，可引起死胎、流产、早产或先天性感染或先天性畸形等。脊髓灰质炎病毒是引起脊髓灰质炎的病毒。该疾病传播广泛，是一种急性传染病。病毒常侵犯中枢神经系统，损害脊髓前角运动神经细胞，导致肢体松弛性麻痹，多见于儿童，故又名小儿麻痹症。掌握“病毒传播方式、感染类型、致病机制及免疫”知识点。